某成年男性，30岁。体重65kg，推荐能量摄入量为2400kcal，蛋白质提供的能量占总能量的12%，该成人每日应摄入蛋白质
A. 65g
B. 72g
C. 75g
D. 78g
E. 85g

正确答案：B。72g